以上牙周膜纤维中符合根间组纤维的特点是
A. 牙周膜中数量最多、力量最强的一组纤维
B. 呈放射状止于根尖周围的牙槽骨
C. 是维持牙齿直立的主要力量，防止牙齿侧方移动
D. 可以防止牙齿根部向冠方移动的作用
E. 主要分布在牙齿的颊舌侧，邻面无此纤维

正确答案：D。可以防止牙齿根部向冠方移动的作用

解析：本题考查牙周膜。根间组：只存在于多根牙，起自根分叉处的牙根间骨隔顶，止于根分叉区牙骨质，有防止牙根向冠方移动的作用（D对）。